上消化道大出血最常见的病因是
A. 门静脉高压症
B. 胆道出血
C. 胃癌
D. 胃淋巴瘤
E. 消化性溃疡

正确答案：E。消化性溃疡

解析：上消化道大出血最常见的病因是消化性溃疡（E对），约占所有病因的50％。门静脉高压症（A错）可致食管胃底静脉曲张破裂，约占上消化道出血病因的25％，胃癌（C错）约占3％。胆道出血（B错）、胃淋巴瘤（D错）导致上消化道出血少见。